（123～125题共用题干）男，59岁，进行性记忆力下降6个月。怀疑有人偷自己的东西，认为爱人对自己不忠诚，常与邻居发生争执，有时尾随年轻女性，行为幼稚、任性。家人无法管理而住院治疗。既往无脑血管病史。生命征及神经系统检查正常。该患者最可能的诊断是
A. 阿尔茨海默症
B. 偏执性精神病
C. 中毒性脑病
D. 血管性痴呆
E. 精神分裂症

正确答案：A。阿尔茨海默症

解析：患者老年男性，进行性记忆力下降6个月（记忆力进行性下降为阿尔茨海默病的典型症状）。怀疑有人偷自己的东西，认为爱人对自己不忠诚（被窃妄想和嫉妒妄想是AD最常见的妄想症状），常与邻居发生争执，有时尾随年轻女性（本能活动的亢进也是AD的常见症状），行为幼稚、任性（智能损害），根据患者的病史和症状，可以诊断为阿尔茨海默病（A对）。偏执性精神病（B错）又称为妄想性障碍，妄想为一种或一整套相互关联的内容，在不涉及妄想内容的情况下，患者不表现明显的精神异常，一般不会出现智能障碍和人格缺损。中毒性脑病（C错）是毒物引起的中枢神经系统器质性病变，该患者无毒物接触史，且生命体征及神经系统检查正常，可排除中毒性脑病。血管性痴呆（D错）是由脑血管病变导致的痴呆，体格检查可有局灶性神经系统症状和体征。精神分裂症（E错）多起病于青壮年，其基本症状为“4A”症状即联想障碍、情感淡漠、矛盾意向及内向性，一般无智能障碍。